草果的功效是
A. 燥湿健脾，祛风湿
B. 燥湿行气，消积平喘
C. 燥湿化痰，降逆止呕
D. 燥湿行气，温中止呕
E. 燥湿温中，除痰截疟

正确答案：E。燥湿温中，除痰截疟

解析：本题考查的草果的功效。草果的功效是燥湿温中，除痰截疟（E对）。草果：【功效】燥湿温中，除痰截疟。苍术：【功效】燥湿健脾，祛风湿（A错），发汗，明目。厚朴：【功效】燥湿，行气，消积，平喘（B错）。半夏：【功效】燥湿化痰，降逆止呕（C错），消痞散结。草豆蔻：【功效】燥湿行气，温中止呕（D错）。